关于掌跖角化-牙周破坏综合征临床表现描述哪项是错误的
A. 皮肤和牙周病变多在4岁前共同出现
B. 患儿智力障碍但身体发育正常
C. 既侵犯乳牙又侵犯恒牙
D. 有深牙周袋，牙槽骨吸收迅速
E. 本病罕见，人群中患病率约为1／100万～4／100万

正确答案：B。患儿智力障碍但身体发育正常

解析：本题考查掌跖角化-牙周破坏综合征的临床表现。本病是一种常染色体隐性遗传病，但患儿智力正常（B错，为本题的正确答案）。掌跖角化-牙周破坏综合征是一种伴有牙周炎的全身性疾病，其特点是手掌和脚掌部位的皮肤过度角化、皲裂和脱屑，牙周组织严重破坏。其临床表现为发病年龄较早，皮肤和牙周病变多在4岁前共同出现（A对）。该病在乳牙萌出不久即可发生；待恒牙萌出后又按萌出的顺序相继发生牙周破坏，既侵犯乳牙又侵犯恒牙（C对）。该病有深牙周袋，牙槽骨吸收迅速（D对），牙齿普遍松动，常在10岁多时即自行脱落或拔除。本病罕见，人群中患病率约为1/100万～4/100万（E对）。